“正气为本”的养生原则包含下列哪项内容
A. 护肾保精，调理脾肺，清静养神，顺应自然
B. 护肾保精，调理脾肺，清静养神，慎避邪气
C. 护肾保精，调神安形，清静养神，慎避邪气
D. 全面调养，调理脾肺，清静养神，慎避邪气
E. 预防为主，护肾保精，调理脾肺，清静养神

正确答案：B。护肾保精，调理脾肺，清静养神，慎避邪气

解析：护肾保精、调理脾肺、清静养神是增强体质、提高正气抗邪能力的重要方法。邪气是导致疾病发生的重要条件，所以未病先防除了养生以增强正气，提高抗病能力之外，还要注意避免病邪的伤害（B对，ACDE错）。